颊部收缩，可将其推送至上下牙列间进行咀嚼
A. 舌在咀嚼中的作用
B. 唇在咀嚼中的作用
C. 颊在咀嚼中的作用
D. 腭在咀嚼中的作用
E. 咽在咀嚼中的作用

正确答案：C。颊在咀嚼中的作用

解析：当颊松弛时口腔前庭内可容纳更多已经初步咀嚼的食物，颊部收缩，可将其推送至上下牙列间进行咀嚼。掌握“牙动度和唇、舌、腭对咀嚼的作用”知识点。